胃癌最常发生的转移途径是
A. 直接蔓延
B. 血性转移
C. 种植转移
D. 淋巴转移
E. 沿肠管转移

正确答案：D。淋巴转移

解析：胃癌可通过多种途径进行转移，其中淋巴转移（D对）为其最常发生的转移途径。直接蔓延（A错）、血道转移（B错）和种植转移（C错）也可发生，但较少见。